邪热内盛，深伏于里，阳气被遏，不能外达，手足厥冷。属于
A. 阳损及阴
B. 阳盛格阴
C. 阴盛格阳
D. 阴损及阳
E. 阴阳脱失

正确答案：B。阳盛格阴

解析：本题考查阴阳失调的各种表现，属理解记忆内容。阳盛于内是疾病的本质，但由于格阴于外，可在原有壮热、面红、气粗、烦躁、舌红、脉数大有力等邪热内盛表现的基础上，又现四肢厥冷、脉象沉伏等假寒之象，故称为真热假寒证。邪热内盛，深伏于里，阳气被遏，不能外达，手足厥冷的表现符合阳盛格阴的表现（B对）。